慢性肾小球肾炎形成蛋白尿的主要病机是
A. 心脾气虚
B. 肺肾气虚
C. 脾肾两虚
D. 心肾阴虚
E. 肝肾阴虚

正确答案：C。脾肾两虚

解析：慢性肾小球肾炎形成蛋白尿主要是脾肾功能失调日久（C对），气阳虚损，使体内水液精微气化及输布过程发生障碍，导致精微外泄（蛋白尿），水湿滞留，肌肤肿满难愈。